位于膀胱颈下方
A. 睾丸
B. 附睾
C. 精囊腺
D. 前列腺
E. 尿道球腺

正确答案：D。前列腺

解析：前列腺（D对）位于膀胱颈的下方。